除另有规定外，散剂的含水量不得超过
A. 0.08
B. 0.09
C. 0.1
D. 0.11
E. 0.12

正确答案：B。0.09

解析：本题考查散剂的质量要求。除另有规定外，散剂的含水量不得超过9.0%（B对）。散剂水分：散剂应做水分检查，照《中国药典》四部通则水分测定法测定，水分不得超过9.0%。颗粒剂水分：照《中国药典》四部水分测定法测定，除另有规定外，不得过8.0%（A错）。茶剂水分：不含糖块状茶剂、袋装茶剂与煎煮茶剂，取供试品(不含糖块状茶剂应研碎），照《中国药典》四部通则水分测定法测定，除另有规定外，不得过12.0%（E错）。